某大学二年级学生，因爸爸经常在家抽烟，他从高中就开始尝试吸烟，现在每天都会抽上1-2支。新学期一开始，学校就公布了新的奖励制度，明确规定吸烟学生不得授予奖学金和优秀称号。他便成功戒烟。戒烟成功是
A. 日常健康行为
B. 避免有害环境行为
C. 保健行为
D. 预警行为
E. 戒除不良嗜好行为

正确答案：E。戒除不良嗜好行为